关于人免疫缺陷病毒（HIV）的特点，哪项错误
A. 传染源是HIV携带者和AIDS患者
B. 引起人类艾滋病
C. 可通过性行为传播
D. 不能经胎盘传播
E. 可通过输血传播

正确答案：D。不能经胎盘传播